鸡蛋煮熟后流动的蛋清变成固体状，此为什么现象
A. 变性蛋白质结絮作用
B. 蛋白质的沉淀
C. 蛋白质凝固
D. 蛋白质解离
E. 蛋白质等电点

正确答案：C。蛋白质凝固

解析：结絮作用所生成的絮状物仍能再溶于强酸或强碱中。如再加热，则絮状物变为比较坚固的凝块，此凝块不易再溶于强酸或强碱中。这种现象称为蛋白质的凝固作用。鸡蛋煮熟后本来流动的蛋清变成了固体状，豆浆中加少量氯化镁即可变成豆腐，都是蛋白质凝固的典型例子。掌握“蛋白质理化性质”知识点。